描述我国大骨节病流行特征中不正确的是
A. 分布于自东北至西南延伸的宽阔带状区域内
B. 性别间差异不明显，但16岁以上男性略高于女性
C. 大骨节病的发病与病区居住年限有关
D. 不同民族、职业发病率之间无差异
E. 大骨节病在一年各季节中发病率有很大差别

正确答案：C。大骨节病的发病与病区居住年限有关

解析：本题考查大骨节病的流行特征。大骨节病是一种地方性、慢性骨关节变形性疾病，以四肢关节软骨和骺板软骨变性坏死、增生、修复为主要病理改变，以骨关节增粗、畸形、强直、肌肉萎缩、运动障碍为主要临床表现。其流行特征表现为：1.地区分布：大骨节病分布于自东北至西南延伸的宽阔带状区域内（A对）；2.人群分布：大骨节病性别间差异不明显，但16岁以上青年及成人患者，男性略高于女性（B对）。发病与病区居住年限无关（C错，为本题正确答案），从外地迁入病区的外来人群，发病率高于本地人群。 不同民族、职业发病率之间无差异（D对），但农业人口高发，且有家庭多发倾向；3.时间分布：大骨节病在一年各季节中发病率有很大差别（E错），研究资料显示，四季分明的温带地区，多发生于春季（3～4月份）；暖地带多发生于冬春之间（2～3月份）；而寒冷地带多发生于春夏之交（4～5月份）。